为抑制胃酸分泌宜选用
A. 奥美拉唑+阿莫西林+克拉霉素
B. 兰索拉唑
C. 硫糖铝
D. 颠茄
E. 甲氧氯普胺

正确答案：B。兰索拉唑

解析：本题考查抑制胃酸分泌药。兰索拉唑（B对）为抑酸剂中的质子泵抑制剂，能够抑制胃酸分泌；奥美拉唑+阿莫西林+克拉霉素（A错）可根除幽门螺杆菌；硫糖铝（C错）为治疗胃溃疡药；颠茄（D错）为解痉药；甲氧氯普胺（E错）是促进胃肠动力药。